以下心血管疾病中最易引起咯血的是
A. 二尖瓣狭窄
B. 肺动脉瓣狭窄
C. 急性心包炎
D. 三尖瓣狭窄
E. 主动脉瓣狭窄

正确答案：A。二尖瓣狭窄

解析：喉及喉部以下的呼吸道及肺任何部位的出血，经口腔咯出称为咯血。心血管疾病中最易引起咯血的是二尖瓣狭窄（A对），其次为先天性心脏病所致肺动脉高压或原发性肺动脉高压，另有肺栓塞和肺血管炎等（九版诊断学P19）。二尖瓣狭窄可使左心房压升高，左心房压升高又导致肺静脉和肺毛细血管压力升高，此时若出现支气管静脉破裂则引起咯血。肺动脉瓣狭窄（B错）主要的病理生理改变为右心室的排血受阻，右心室压力增高，右心室代偿性肥厚，最终导致右心衰竭；三尖瓣狭窄（D错）主要病理生理改变为右心房血液流入右心室受阻，右心房压力增高而出现代偿性肥厚，两者都可引起肺循环血量减少，一般不会出现咯血症状。急性心包炎（P302）（C错）伴大量心包积液时可出现肺淤血；主动脉瓣狭窄（P295）（E错）晚期也可导致肺静脉压、肺毛细血管楔压和肺动脉压增加，因此患者也可出现咯血症状，但临床并不多见。